窝沟封闭酸蚀牙面范围为
A. 牙尖斜面的1/3
B. 牙尖斜面的2/3
C. 牙尖斜面的1/2
D. （牙合）面
E. 暴露在口腔的牙冠

正确答案：B。牙尖斜面的2/3

解析：酸蚀剂可为磷酸液或含磷酸的凝胶，酸蚀面积应为接受封闭的范围，一般为牙尖斜面的2/3。掌握“窝沟封闭术”知识点。